抽样调查了某地103名10岁男孩的生长发育情况，得身高均数为142.82cm，标准差为5.63cm；体重均数为28.24kg，标准差为5.62kg。比较身高和体重的变异程度，下列结论正确的是
A. 身高变异程度大
B. 体重变异程度大
C. 身高与体重的变异程度相同
D. 由于单位不同，无法比较两者的变异程度
E. 题中所给条件不足，无法判断

正确答案：B。体重变异程度大

解析：本题考查变异系数的相关内容。变异系数是一个度量相对离散程度的指标，为了解单位相同但均数相差悬殊的变量之间的变异程度，以及比较几个不同单位的变量的变异程度，可把标准差除以均数CV=s/x̅*100%，身高的CV=5.63/142.82=3.9%,体重的CV=5.62/28.24=19.9%，因此19.9%＞3.9%，所以体重变异程度大（B对ACDE错）。